男，64岁，右上12345缺失，左上123678缺失，右下56缺失，左下5678缺失，首次接受可摘局部义齿修复。戴牙后除咬下唇外无不适，其原因是
A. 上前牙排向唇侧较多
B. 前牙排列的覆盖过小
C. 前牙排成深覆（牙合）
D. 垂直距离低，致唇松弛
E. 患者下唇肌肉松弛

正确答案：B。前牙排列的覆盖过小

解析：本题考查义齿戴用后出现咬下唇的原因。正常可摘局部义齿的人工牙排列应有一定的覆（牙合）、覆盖。若上下前牙的覆盖过小（B对），唇部软组织向内凹陷，则会造成咬下唇现象。若上前牙排向唇侧较多（A错），即覆盖过大，唇部软组织被撑起，不会出现咬下唇现象。若人工牙排列时前牙排成深覆（牙合）（C错），则会导致垂直距离降低，直距离低（D错）可导致患者咀嚼效率降低，但不会出现咬唇现象。下唇肌肉松弛（E错）则表现为唇部组织下垂亦不会出现咬下唇现象。